属于分泌管作用的是
A. 能发挥干细胞作用
B. 钠泵作用
C. 分化为肌上皮细胞
D. 分化为分泌管细胞
E. 分化为分泌细胞

正确答案：B。钠泵作用

解析：分泌管上皮细胞能主动吸收Na+、排出K+和HCO3-，并转运水，改变原始唾液量并使分泌物低渗。此功能受肾上腺皮质分泌的醛固酮等激素的调节，而细胞底部的折叠与密集的线粒体则起“钠泵”作用。掌握“唾液腺组织结构”知识点。